广泛地应用于治疗海洛因成瘾的药物是
A. 吗啡
B. 美沙酮
C. 哌替啶
D. 纳曲酮
E. 曲马多

正确答案：B。美沙酮